男性，65岁。皮肤巩膜黄染进行性加重1个月来诊。自述尿色深黄，大便灰白色，查体叩诊胆囊无肿大，Murphy征阴性，腹部未扪及肿块。诊断首先考虑为
A. 胰头癌
B. 胆总管下端癌
C. 乏特壶腹癌
D. 肝门部胆管癌
E. 十二肠腺癌

正确答案：D。肝门部胆管癌

解析：老年男性，皮肤巩膜黄染进行性加重1个月、尿色深黄、大便灰白色（梗阻性黄疸）。胆囊无肿大，Murphy征阴性，腹部未扪及肿块（病变位于胆管上段），首先考虑肝门部胆管癌（D对）。胰头癌（P463）（A错）、胆总管下端癌（P465）（B错）、乏特壶腹癌（P465）（C错）均位于胆道下段，可引起上段胆道扩张及胆囊肿大。当十二指肠腺癌（E错）生长巨大时，可引起胆囊肿大及黄疸，当癌肿小不足以压迫胆总管下段时，则不会引起黄疸及胆囊肿大。